患儿，7岁。发热1天，恶寒，无汗，头痛，鼻塞流清涕，喷嚏咳嗽，口不渴，咽不红，舌苔薄白，脉浮紧。其证候是
A. 风寒感冒
B. 风热感冒
C. 暑邪感冒
D. 感冒夹滞
E. 感冒夹痰

正确答案：A。风寒感冒

解析：题中患儿以发热1天，恶寒，无汗，鼻塞流清涕，喷嚏咳嗽为主症，故诊断为感冒。患儿发热，恶寒，无汗，头痛为外感风寒，客于腠理，邪正交争，肌表被束所致，风寒客肺，肺气失宣，故鼻塞流清涕，咳嗽，喷嚏。咽不红，舌苔薄白，脉浮紧为外感风寒之象，故辨为风寒感冒（A对）。风热感冒多流浊涕，咳嗽声重，痰稠色白或黄，咽红或咽痛，舌质红，苔薄黄，脉浮数（B错）。暑邪感冒多有身重困倦，胸闷，泛恶，食欲不振或伴呕吐、泄泻，舌质红，苔黄腻，脉数（C错）。感冒夹滞多伴脘腹胀满，不思饮食，呕吐酸腐，口气秽浊，大便酸臭，或腹痛泄泻，或大便秘结，小便短黄（D错）。感冒夹痰咳嗽多较剧烈，痰多，喉间痰鸣（E错）。